重症肌无力的自身抗原是
A. 平滑肌
B. 乙酰胆碱受体
C. 胰岛素受体
D. 细胞核
E. 血小板

正确答案：B。乙酰胆碱受体